抑制HMG-CoA还原酶的药物是
A. 卡托普利
B. 米力农
C. 氯沙坦
D. 洛伐他汀
E. 阿司匹林

正确答案：D。洛伐他汀

解析：本题考查抑制HMG-CoA还原酶的药物。洛伐他汀（D对）为羟甲基戊二酰辅酶A还原酶抑制剂类调血脂药，对羟甲基戊二酰辅酶A还原酶产生竞争性的抑制作用，结果使血总胆固醇、低密度脂蛋白和载脂蛋白B水平降低，对动脉粥样硬化和冠心病的防治产生作用。卡托普利（A错）为常用的血管紧张素转换酶抑制剂，可抑制血管紧张素转换酶的活性，抑制血管紧张素Ｉ转换成血管紧张素Ⅱ；同时作用于缓激肽系统，抑制缓激肽的降解，从而扩张血管。临床用于高血压，心力衰竭，高血压急症。米力农（B错）为非强心苷类正性肌力药，属于磷酸二酯酶Ⅲ抑制剂，可提高心肌细胞内环磷腺苷水平而增强心肌收缩力，并扩张外周血管，用于心力衰竭时作短时间的支持治疗。氯沙坦（C错）为血管紧张素Ⅱ受体阻断剂，可拮抗血管紧张素Ⅱ与AT₁受体结合、松弛血管平滑肌、减少钠水潴留，主要用于高血压治疗。阿司匹林（E错）为非甾体抗炎药，可抑制炎症细胞的花生四烯酸代谢物-环氧酶，减少炎症介质，从而抑制前列腺素和血栓素的合成，发挥解热、镇痛、抗炎作用。